球状突来自于
A. 中鼻突
B. 下颌突
C. 鼻额突
D. 侧鼻突
E. 球状突

正确答案：A。中鼻突

解析：本题考查面部的发育。球状突来自于中鼻突（A对）。胚胎第3周，发育中的前脑生长迅速，其下端出现了一个突起称额鼻突（C错），此时由于迁移的神经嵴细胞的增生，在额鼻突两侧的下方出现第一鳃弓。约在胚胎24天，第一鳃弓上出现另一个突起即上颌突。此时的原口界限是上有迅速增大的额鼻突、下有第一鳃弓（此时称下颌突）（B错） ，两侧为上颌突。在胚胎第4周末，额鼻突下端出现了鼻板，继而发育为鼻凹，其外侧为侧鼻突（D错）。